关于CO的叙述中，错误的是
A. 急性CO中毒的严重程度与血中COHb含量无关
B. 血中COHb含量与空气中的CO浓度呈正相关
C. 急性CO中毒以神经系统症状为主
D. 胎儿对CO的毒性比成人敏感
E. 吸烟者血中的COHb浓度比非吸烟者高

正确答案：A。急性CO中毒的严重程度与血中COHb含量无关

解析：本题考查CO的相关内容。CO很容易通过肺泡、毛细血管以及胎盘屏障。吸收入血以后，80%～90%的CO与血红蛋白结合形成碳氧血红蛋白（COHb）。血中COHb含量与空气中CO的浓度呈正相关（B对），正常人COHb饱和度为0.4%～2.0%，贫血者略高。急性CO中毒以神经系统症状为主（C对），其严重程度与血中COHb含量有关（A错，为本题正确答案）。正常胎儿血中的COHb浓度高出母体10%～15%，胎儿对CO的毒性比成人敏感（D对）。研究证实，妊娠妇女吸烟可引起胎儿血中COHb浓度上升至2%～10%（E对），其结果是导致低体重儿、围产期死亡增高以及婴幼儿的神经行为障碍。